男，28岁。6小时前从4米高处坠落，不能站立行走，查体：左小腿明显肿胀，中段畸形，足背动脉搏动减弱，皮肤温度较对侧降低，被动屈伸足趾时疼痛加重。预后状况最主要取决于
A. 手术减压的早晚
B. 外固定时间的长短
C. 内固定方式的洗择
D. 有无应用脱水抗感染治疗
E. 有无及早抬高患肢

正确答案：A。手术减压的早晚

解析：患者青年男性，从高处坠落，不能站立行走。查体：左小腿明显肿胀（缺血水肿），中段畸形（考虑骨折），足背动脉搏动减弱，皮肤温度较对侧降低，被动屈伸足趾时疼痛加重（骨筋膜室综合征典型体征）。结合患者症状及体征，考虑患者为胫腓骨骨折后导致的骨筋膜室综合征。骨筋膜室综合征的预后状况主要取决于手术减压的早晚（A对），减压早部分功能可恢复，减压晚则会大部分肌肉坏死严重影响病肢功能。外固定时间的长短（B错）会影响骨折后肢体运动的恢复情况。内固定方式的洗择（C错）影响骨折恢复时间。应用脱水抗感染治疗（D错）主要适用于开放性骨折。及早抬高患肢（E错）可以帮助患肢血液回流，但不是影响预后的主要原因。